女，40岁。因持续胸痛1天就诊。10天前曾发热伴咳嗽。查体：BP120/70mmHg，心界不大，心率84次/分，律齐，胸骨左缘第3、4肋间可闻及性质粗糙、高音调与心搏一致的双期搔抓样音，与呼吸无关。该患者最可能的诊断是
A. 限制型心肌病
B. 病毒性心肌炎
C. 急性心包炎
D. 肥厚型心肌病
E. 急性胸膜炎

正确答案：C。急性心包炎

解析：患者中年女性，10天前曾发热伴咳嗽（提示有感染病史），现出现持续胸痛，胸骨左缘第3、4肋间可闻及性质粗糙高音调与心搏一致的双期搔抓样音（即心包摩擦音，为急性心包炎的特异性体征），与呼吸无关（提示非胸膜杂音），结合患者的病史和体征，该患者最可能的诊断是急性心包炎（C对）。限制型心肌病（P269）（A错）主要表现为活动耐量下降、乏力、呼吸困难，右心衰较重为其特点；病毒性心肌炎（P270）（B错）也常有感染前驱病史，但多数以心律失常为主诉或首见症状；肥厚型心肌病（P266）（D错）多表现为劳力性呼吸困难和乏力，可伴劳力性胸痛、晕厥等症状；急性胸膜炎（E错）表现为胸痛，由于呼吸时胸膜的摩擦，胸痛呈吸气明显，屏气消失的特点，而且这四种疾病均不会出现胸骨左缘第3、4肋间性质粗糙高音调与心搏一致的双期搔抓样音。